女，74岁。5天前诊断为“急性前壁心肌梗死”，今日再感胸痛，随即意识丧失。心电监护和生命体征监测示无脉电活动。该患者意识丧失的最可能原因是
A. 心脏破裂
B. 心源性休克
C. 乳头肌断裂
D. 再发心肌梗死
E. 室间隔穿孔

正确答案：A。心脏破裂

解析：患者5天前诊断为急性前壁心肌梗死（急性心梗引起心脏破裂多在起病1周内出现，造成心包积血引起心脏压塞而猝死），今日再感胸痛，随即意识丧失。心电监护和生命体征监测示无脉电活动（急性心梗引起心室破裂、大面积肺梗死，导致猝死的表现），根据患者病史及检查，意识丧失的最可能原因是急性心梗引起心脏破裂（A对D错）。急性心梗致室间隔穿孔（E错）可引起心衰和休克而在数日内死亡，少见。乳头肌断裂（C错）多见于下壁心梗，心衰明显，可迅速发生肺水肿在数日内死亡。心源性休克（B错）通常不会引起猝死。